耻骨联合上缘至股骨内上髁上缘的骨度分寸是
A. 18寸
B. 19寸
C. 20寸
D. 21寸
E. 22寸

正确答案：A。18寸

解析：耻骨联合上缘至股骨内上髁上缘的骨度分寸是18寸（A对）。股骨大转子至腘横纹为19寸（BCDE错）。